急进性肾小球肾炎Ⅱ型最常见的检测异常是
A. 循环免疫复合物阳性
B. 血抗肾小球基底膜抗体阳性
C. 血清中性粒细胞胞浆抗体（ANCA）阳性
D. 血单克隆免疫球蛋白升高
E. 血冷球蛋白阳性

正确答案：A。循环免疫复合物阳性

解析：急进性肾小球肾炎根据免疫病理可分为三型：①I型，又称抗基底膜型肾小球肾炎，由于抗基底膜抗体与基底膜抗原相结合激活补体而致病（B错）；②II型，又称免疫复合物型，因肾小球内循环免疫复合物的沉积或原位免疫复合物形成，激活补体而致病（A对）；③III型，为少免疫复合物型，肾小球内无或仅微量免疫球蛋白沉积。现已证实50%~80%的III型患者为原发性小血管炎肾损害·，肾脏可为首发、甚至唯一受累器官或与其他系统损害并存。原发性小血管炎肾损害患者血清抗中性粒细胞胞质抗体（ANCA）常呈阳性（C错）（P467）。免疫学检查异常主要有抗基底膜（GBM）抗体阳性（I型）和ANCA阳性（III型）（BC错）。此外，II型患者的血液循环免疫复合物及冷球蛋白可呈阳性（题干为最常见，故A对E错），并可伴血清C3降低。血单克隆免疫球蛋白升高常见于浆细胞相关疾病（D错）。